男，25岁，间断咳嗽、咳痰带血1个月，乏力、纳差伴尿少、水肿1周。实验室检查：血WBC8.6×10⁹/L，血红蛋白90g/L，尿蛋白（++），尿沉渣镜检红细胞8～10/HP，血肌酐268μmol/L，尿素氮22.6mmol/L，抗肾小球基底膜抗体（+），ANCA阴性。其肾脏最可能的病理类型为
A. 微小病变肾病
B. 新月体性肾小球肾炎
C. 系膜增生性肾小球肾炎
D. 毛细血管内增生性肾小球肾炎
E. 膜性肾病

正确答案：B。新月体性肾小球肾炎

解析：男，25岁，间断咳嗽、咳痰带血1个月，乏力、纳差伴尿少、水肿1周。实验室检查：血WBC8.6×10⁹/L，血红蛋白90g/L，尿蛋白（++），尿沉渣镜检红细胞8～10/HP（正常＜3/HP），血肌酐268μmol/L，尿素氮22.6mmol/L，抗肾小球基底膜抗体（+），ANCA阴性。根据免疫学检查，其肾脏最可能的病理类型为新月体性肾小球肾炎。